半数有效量（ED50）
A. 引起50%动物死亡的剂量
B. 引起50%动物中毒的剂量
C. 引起50%动物产生阳性反应的剂量
D. 和50%受体结合的剂量
E. 达到50%有效血药浓度的剂量

正确答案：C。引起50%动物产生阳性反应的剂量

解析：质反应中，能引起50%的实验动物出现阳性反应的药物剂量或浓度，量反应中，能引起50%最大效应的药物剂量或浓度，均称为半数有效剂量（ED50）或半数有效浓度（EC50）。如效应为死亡，则称为半数致死量（median　lethal　dose，LD50）。掌握“药物与受体、剂量与效应关系”知识点。